甲是药品上市许可持有人，持有并生产的品种包括处方药硝苯地平控释片、鱼腥草注射液；中药饮片黄芪；非处方药维生素C泡腾片。乙是药品批发企业，长期与甲保持业务关系，从甲处采购硝苯地平控释片、中药饮片黄芪、维生素C泡腾片。最近决定首次从甲处采购鱼腥草注射液，甲将乙釆购的四种药品同车运输至乙处，乙将到货药品储存在同一间库房。关于乙从甲处采购鱼腥草注射液的行为，符合规定的是
A. 乙应当审核药品的合法性并索取药品批准证明文件原件予以保存
B. 因长期与甲保持业务关系，乙的采购部门可以直接做出采购决定
C. 乙必须组织实地考察，对甲的质量管理体系进行评价后，再做出采购决定
D. 乙的采购部门提出申请后，由乙的质量管理部门和质量负责人审核、批准

正确答案：D。乙的采购部门提出申请后，由乙的质量管理部门和质量负责人审核、批准

解析：本题考查的是药品经营质量管理规范的批发主要内容。甲是药品上市许可持有人，持有并生产的品种包括处方药硝苯地平控释片、鱼腥草注射液；中药饮片黄芪；非处方药维生素C泡腾片。乙是药品批发企业，长期与甲保持业务关系，从甲处采购硝苯地平控释片、中药饮片黄芪、维生素C泡腾片。最近决定首次从甲处采购鱼腥草注射液，甲将乙釆购的四种药品同车运输至乙处，乙将到货药品储存在同一间库房。关于乙从甲处采购鱼腥草注射液的行为，符合规定的是乙的采购部门提出申请后，由乙的质量管理部门和质量负责人审核、批准（D对）。药品批发采购首营企业与首营品种的审核：对于首营企业与品种，采购部门应当填写相关申请表格，经过质量管理部门和企业质量负责人的审核批准（B错）。必要时应当组织实地考察，对供货单位质量管理体系进行评价（C错）。对首营企业的审核，应当查验加盖其公章原印章的以下资料，确认真实、有效：《药品生产许可证》或者《药品经营许可证》复印件；营业执照、税务登记、组织机构代码的证件复印件，以及上一年度企业年度报告公示情况；相关印章、随货同行单（票）样式；开户户名、开户银行及账号。采购首营品种应当审核药品的合法性，索取加盖供货单位公章原印章的药品生产或者进口批准证明文件复印件（A错）并予以审核，审核无误的方可采购。以上资料应当归入药品质量档案。